气逆最常见的脏腑是
A. 肺胃肾
B. 心胃肝
C. 肝胃肾
D. 肺胃肝
E. 肝肺肾

正确答案：D。肺胃肝

解析：肺气失于宣发肃降，上逆而致咳嗽、喘息；因寒饮，痰浊，食积停滞于胃，阻碍气机，胃气上逆，则见呃逆、嗳气、恶心、呕吐等症；肝气上逆多因郁怒伤肝，肝气升发太过，气火上逆则见头痛、眩晕、昏厥，血随气逆而上涌，可导致呕血。肺主气，胃气宜降，肝主疏泄，调畅气机，因此多见肺、胃、肝（D对）。